5%的葡萄糖注射液采用的采购方式为
A. 直接挂网采购
B. 谈判采购
C. 按现行规定采购
D. 国家定点生产

正确答案：A。直接挂网采购

解析：本题考查药品分类采购。10%葡萄糖注射液属于基础输液，实行集中挂网，由医院直接采购，为直接挂网采购药品（A对）。谈判采购药品（B错）：对部分专利药品、独家生产药品，建立公开透明、多方参与的价格谈判机制。谈判结果在国家药品供应保障综合管理信息平台上公布，医院按谈判结果采购药品。仍按现行规定采购的药品（C错）：麻醉药品和第一类精神药品、防治传染病和寄生虫病的免费用药、国家免疫规划疫苗、计划生育药品及中药饮片。国家定点生产的药品（D错）：对临床必需、用量小、市场供应短缺的药品，由国家招标定点生产、议价采购。根据《关于2016年临床必需、用量小、市场供应短缺药品定点生产试点有关事项的通知》（国卫药政函〔2016〕365号），国家卫生健康委员会目前已组织完成地高辛口服溶液、复方磺胺甲噁唑注射液、注射用对氨基水杨酸钠等3个药品品种的定点生产企业招标工作。